以下关于棘层内疱的描述中，不正确的是
A. 可见于良性类天疱疮
B. 有棘层松解
C. 可见于病毒性水疱
D. 疱在上皮的棘层内或在基底层上
E. 上皮细胞失去黏附力而彼此分离

正确答案：A。可见于良性类天疱疮

解析：棘层内疱：疱在上皮的棘层内或在基底层之上，有棘层松解，上皮细胞失去黏附力而彼此分离。见于天疱疮，也见于病毒性水疱。掌握“口腔黏膜基本病理变化”知识点。